患者男，28岁。反复发作性干咳伴胸闷2年，多于春季发作，无发热、咯血及夜间阵发性呼吸困难，多次胸片检查无异常，常用抗生素治疗效果不明显。无高血压病史。全身体检无阳性体征。为明确诊断首选的检查是
A. 胸部CT
B. 心脏超声波
C. 支气管激发试验
D. 动脉血气分析
E. 血常规

正确答案：C。支气管激发试验

解析：此患者为咳嗽变异型哮喘，唯一临床表现为反复发作的干咳，用支气管激发试验能确诊。掌握“支气管哮喘”知识点。